治疗上消化道出血应选用的药物是
A. 去甲肾上腺素
B. 多巴胺
C. 麻黄碱
D. 肾上腺素
E. 可乐定

正确答案：A。去甲肾上腺素